关于釉柱的排列方向的临床意义，以下说法错误的是
A. 绞釉排列可增强抗剪切程度
B. 治疗龋洞时，不能保留悬空釉柱
C. 劈裂釉质时需要按照釉柱的排列方向进行
D. 平滑面龋呈尖端向釉牙本质界的三角形
E. 根面龋的形态与平滑面龋同为三角形

正确答案：E。根面龋的形态与平滑面龋同为三角形

解析：牙齿根面没有牙釉质存在，故根面龋的形状不是三角形，而是不规则的形状。掌握“牙釉质”知识点。